氨基酸中人体必需氨基酸的是
A. 甘氨酸
B. 精氨酸
C. 苏氨酸
D. 脯氨酸
E. 丝氨酸

正确答案：C。苏氨酸